下列对棘层松解的理解正确的一项是
A. 上皮棘层细胞间桥溶解，棘层形成裂隙或疱
B. 上皮棘层细胞减少，上皮层变薄
C. 棘层增厚，不规则
D. 黏膜或皮肤的角化层过度增厚
E. 上皮浅层破坏，未侵犯上皮全层

正确答案：A。上皮棘层细胞间桥溶解，棘层形成裂隙或疱

解析：棘层松解是由于上皮棘层细胞间张力原纤维及黏合物质发生变性、断裂破坏，细胞间桥溶解，而使棘细胞间联系力松弛、断裂，严重时失去联系、解离，在棘层形成裂隙或疱。此种病变见于天疱疮等。掌握“口腔黏膜基本病理变化”知识点。